呕吐的基本病机是
A. 肝气犯胃，胃气上逆
B. 胃失和降，胃气上逆
C. 食滞伤胃，胃失和降
D. 外邪犯胃，胃失和降
E. 脾胃受损，胃失润降

正确答案：B。胃失和降，胃气上逆

解析：呕吐是胃失和降，气逆于上，迫使胃中之物从口中吐出的一种病证。无论是肝气犯胃，食滞伤胃，外邪犯胃还是脾胃受损，均导致胃失和降，胃气上逆，而发为呕吐。呕吐总的来讲，实者由外邪、饮食、痰饮等邪气犯胃，致胃失和降，气逆而发病；虚者由于气虚、阳虚、阴虚等正气不足，使胃失温养、濡润，胃气不降而发病，故其基本病机为胃失和降，胃气上逆（B对）（ACDE错）。